常与抗菌增效剂合用
A. 环丙沙星
B. 左氧沙星
C. 司帕沙星
D. 磺胺嘧啶银
E. 磺胺甲噁唑

正确答案：E。磺胺甲噁唑

解析：本题考查药物的联合应用。磺胺甲噁唑（E对）常与抗菌增效剂合用。甲氧苄啶可增强磺胺类的抗菌作用，因此常将其与磺胺类药制成复方制剂应用。磺胺嘧啶银（D错）是磺胺嘧啶的银盐制成的外用药，可发挥磺胺嘧啶与银盐的双重作用。环丙沙星（A错）、左氧沙星（B错）、司帕沙星（C错）不需与抗菌增效剂合用。